与肝癌相关的肿瘤抗原是
A. CEA
B. AFP
C. TSA
D. CTA
E. PSA

正确答案：B。AFP

解析：甲胎蛋白（AFP）（B对）属于肿瘤相关抗原，并不是肿瘤特异性抗原（TSA）（C错），在胎儿发育过程中表达，但是在出生后的短时间内就会表达抑制，但是它会在肝细胞癌患者中表达增加，成为检测肝癌的主要肿瘤相关抗原。CEA用于结肠癌的检测（A错）。CTA（D错）是CT下动脉造影技术，是一项检查技术。PSA是前列腺癌的特异抗原用于前列腺癌的检测（E错）。